泄泻的病理因素最为多见的是
A. 寒
B. 湿
C. 热
D. 滞
E. 痰

正确答案：B。湿

解析：泄泻的病变主脏在脾，主要病机为脾虚湿盛，湿为阴邪，易困脾阳，但亦可夹寒、夹热、夹滞，使脾运失职，小肠无以分清泌浊，故发生泄泻，常有无湿不成泻之说，痰不是泄泻的病理因素（B对）（ACDE错）。